女婴，5个月。咳嗽伴发热三天，喘憋1天。无明显咳痰，体温波动在38℃～39℃，喘憋进行性加重。查体：T38.5℃，P150次/分，R60次/分，精神、反应可，双肺哮鸣音，双下肺可闻及细湿啰音，腹软，无明显压痛，肝肋下2cm。入院后患儿出现惊厥、双眼凝视、对光反射迟钝。正确的药物治疗不包括
A. 毛花苷丙
B. 甘露醇
C. 地塞米松
D. 酚妥拉明
E. 地西泮

正确答案：A。毛花苷丙

解析：肺炎合并缺氧中毒性脑病的治疗：①脱水疗法：主要使用甘露醇（B对）②改善通气③扩血管药物：可缓解脑血管痉挛、改善脑微循环，从而减轻脑水肿，常用酚妥拉明（D对）、山莨菪碱。④止痉：一般选用地西泮（E对）⑤糖皮质激素的使用：可非特异性抗炎、减少血管与血脑屏障的通透性，故可用于治疗脑水肿。常用地塞米松（C对）。⑥促进脑细胞恢复的药物：常用的有三磷酸腺苷（ATP）、胞磷胆碱、维生素B₁和维生素B₆等。毛花苷丙为肺炎合并心衰时的药物治疗，该患者缺氧中毒性脑病明显而心衰症状不显著（A错，为本题正确答案）。